窝洞制备时，抗力形中的要求，哪一项是错误的
A. 洞的深度达到釉牙本质界下0.5mm
B. 盒形洞形：底平，壁直
C. 复面洞阶梯的龈壁为向颈方的斜面
D. 去除薄壁弱尖
E. 洞缘曲线圆钝

正确答案：C。复面洞阶梯的龈壁为向颈方的斜面

解析：本题考查窝洞的抗力形。复面洞阶梯的邻面龈壁应于牙长轴垂直（C错，为本题的正确答案），以承担咬合压力。窝洞制备时，窝洞的深度应达到釉牙本质界下0.5mm（A对），以保证充填体厚度，增加充填体的抗力。盒形洞形要求底平，壁直，点、线角圆钝（B对），使咬合力均匀分布，避免产生应力集中。去除薄壁弱尖可防止患牙在咬合受力时折断（D对）。洞曲线圆钝可避免应力集中造成的牙齿折裂（E对）。